下列何种疾病与牙周病没有密切关系
A. 糖尿病
B. 白血病
C. 心血管疾病
D. 大叶性肺炎
E. 再生障碍性贫血

正确答案：D。大叶性肺炎

解析：与牙周病有关的系统性疾病，如血液病（急性白血病、血小板减少性紫癜等）、心血管疾病、糖尿病或其他内分泌疾病、神经系统疾病、免疫功能缺陷以及某些遗传性疾病或有遗传易感因素等；同时发生在口腔及牙周组织的疾病，如口腔黏膜白斑、扁平苔藓、天疱疮、类天疱疮等均可同时发生于口腔黏膜和牙龈，正畸治疗史等。此外，还应问家族史，询问父母、兄弟姐妹或其他直系亲属的牙周健康状况，尤其是一些与遗传可能相关的牙周病，如侵袭性牙周炎、牙龈纤维瘤病等。掌握“牙周疾病与全身疾病和健康的关系”知识点。